眶底骨折手术复位的目的是
A. 恢复眶下壁骨质的连续性
B. 使嵌顿的眼球下直肌和脂肪复位
C. 恢复眶腔容积和眼球活动
D. 改善眼球内陷
E. 以上均是

正确答案：E。以上均是

解析：眶底骨折手术复位的目的是恢复眶下壁骨质的连续性，使嵌顿的眼球下直肌和脂肪复位，恢复眶腔容积和眼球活动，改善眼球内陷和复视。掌握“颧骨及颧弓、眼眶骨折及骨折愈合过程”知识点。